可用于软胶囊中的分散介质是
A. 二氧化硅
B. 二氧化钛
C. 二氯甲烷
D. 聚乙二醇400
E. 聚乙烯吡咯烷酮

正确答案：D。聚乙二醇400

解析：本题考查胶囊剂。有些软胶囊中的主药不溶于溶剂，多采用聚乙二醇400（D对）作分散介质；二氧化硅（A错）在食品工业是优良的促进剂；二氧化钛（B错）是应用广泛的白色素；二氯甲烷（C错）可作为反应介质；聚乙烯吡咯烷酮（E错）为不溶性食品添加剂。